与可摘局部义齿比，不是固定义齿特点的是
A. 不易磨耗
B. 咀嚼效率高
C. 舒适
D. 稳固
E. （牙合）关系好

正确答案：E。（牙合）关系好

解析：（牙合）关系好是可摘局部义齿与固定义齿所共有的特点。掌握“固定桥的组成和分类”知识点。